男，24岁。右股骨中段粉碎性骨折，手术复位时彻底清除骨折碎片，行钢板内固定。半年后骨折仍未愈合。最可能的原因是
A. 骨折碎片清除过多
B. 骨折处血液循环差
C. 骨折固定不确定
D. 未配合药物治疗
E. 功能锻炼不够

正确答案：A。骨折碎片清除过多

解析：青年男性（全身因素良好），右股骨中段粉碎性骨折，手术复位时彻底清除骨折碎片，骨折碎片清除过多，造成骨质缺损，影响骨折愈合（A对）（P620），骨折部位血液供应是影响骨折愈合的因素，右股骨中段血液供应良好，不是此处骨折未愈合的最可能原因（P619）（B错）。行钢板内固定，内固定主要用于闭合或切开复位后，采用金属内固定物，如接骨板、螺丝钉、髓内钉或带锁髓内钉和加压钢板（P623），是良好的固定方式（C错）。药物治疗对骨折愈合不能起到关键性作用，未配合药物治疗（D错）不是骨折未愈合的最可能原因。过早或不恰当地功能锻炼可能妨碍骨折部位的固定，影响骨折愈合，功能锻炼不够不是骨折未愈合的最可能原因（E错）（P620）。